铅中毒时可出现
A. 书写过小症
B. 肌束震颤
C. 腕下垂
D. 高铁血红蛋白血症
E. 意向性震颤

正确答案：C。腕下垂